防止疟疾复发的药物是
A. 吡喹酮
B. 氯喹
C. 乙胺嘧啶
D. 伯氨喹
E. 奎宁

正确答案：D。伯氨喹

解析：吡喹酮（A错）为广谱抗吸虫药和驱绦虫药，对多种吸虫有强大的杀灭作用，对绦虫感染和囊虫病也有良好效果。氯喹、奎宁能杀灭红细胞内期裂殖体，主要用于控制症状发作和预防性抑制疟疾症状发作（BE错）。乙胺嘧啶（C错）能杀灭红细胞外期的子孢子发挥病因性预防。伯氨喹（D对），能杀灭肝细胞中休眠子，控制疟疾的复发；并能杀灭各种疟原虫的配子体，控制疟疾传播。